非少尿型急性肾衰竭
A. ＜100mL/24h
B. ＜200mL/24h
C. ＜400mL/24h
D. ＞800mL/24h
E. ＞1000mL/24h

正确答案：E。＞1000mL/24h

解析：非少尿型急性肾衰竭主要为氮质血症、尿比重降低且有管型，因烧伤败血症或肾病综合征引起者，实验室检查非蛋白氮在71～143mmol/L之间，肾小管对钾、钠、氯等电解质的调节功能一般保持正常，尿量正常或偏多；正常人每日尿量1000～1500mL（E对）。尿量＜100mL/d（A错），为无尿。尿量＜400mL/d（C错），为少尿。